中药中的有害物质通常是指
A. 残留农药
B. 重金属
C. 砷盐
D. 杂质
E. 霉菌毒素

正确答案：A、B、C、E。残留农药；重金属；砷盐；霉菌毒素

解析：本题考查的是中药的安全性检查。中药中的有害物质通常是指残留农药（A对）、重金属（B对）、砷盐（C对）、霉菌毒素（E对）。中药的安全性检查包括内源性有毒、有害物质及检测与外源性有害物质及检测。1.内源性有毒、有害物质及检测：中药中主要的内源性有毒、有害特质是指中药本身所含的具有毒副作用的化学成分。这些化学成分大多为生物的次生代谢产物，如肾毒性成分的马兜铃酸、肝毒性成分的吡咯里西啶生物碱及具有双重作用的成分等。2.外源性有害物质及检测：包括重金属及有害元素、农药残留量、黄曲霉毒素与二氧化硫残留量等。杂质（D错）检查属于纯度检测。纯度检查：中药的纯度与中药质量密切相关，常影响中药质量的优劣程度和临床用药剂量的准确性。《中国药典》中与纯度相关的检查主要包括杂质检查、水分测定、干燥失重、灰分测定、色度检查、酸败度测定等，并已成为中药质量评价中的常规检查项。